深部脓肿如果需要送病理检查时，则需要
A. 穿刺检查
B. 涂片检查
C. 活体组织检查
D. 手术探查
E. 影像学检查

正确答案：A。穿刺检查

解析：穿刺检查：通过穿刺抽吸肿块内容物，了解内容物的颜色、透明度、黏稠度等性质，可以进一步协助诊断，例如：静脉畸形可有血液抽出；舌下腺囊肿有蛋清样黏液抽出；脓肿可以抽出脓液。必要时抽出物还应送病理或涂片检查，以进一步确定其性质。掌握“口外一般检查及辅助检查”知识点。